下列除哪项外，均为甲状腺功能亢进症的表现
A. 甲状腺肿大
B. 情绪激动
C. 周围血管体征
D. 肝大
E. 心动过缓

正确答案：E。心动过缓

解析：甲状腺功能亢进症主要表现为不同程度的甲状腺肿大（A对）、易激动（B对）、烦躁失眠、心悸、乏力、肝脾增大（D对）、可闻及血管杂音、周围血管体征（C对），心动过速（E错，为本题正确答案）。